手太阳小肠经与足太阳膀胱经的交接部位是
A. 目外眦
B. 目内眦
C. 目中
D. 鼻旁
E. 口角旁

正确答案：B。目内眦

解析：该题考查十二经脉的循行走向交接规律。手太阳小肠经与足太阳膀胱经在目内眦交接（B对），目外眦是手少阳三焦经和足少阳胆经的交接部位（A错），目中为干扰选项（C错），鼻旁为手阳明大肠经和足阳明胃经的交接部位（D错），口角旁为干扰选项（E错）。记忆：同名阳经在头面部交接，阳明-鼻旁，太阳-目内眦，少阳-目外眦。